患者男性，55岁，因右上颌牙痛三天，右侧眼下、鼻侧肿胀一天而就诊。检查：右侧上颌尖牙远中深龋，探（-），叩（++），松动（-），前庭沟肿胀变浅，同侧鼻侧、眶下区肿胀明显，局部皮温增高，压痛和波动感存在，眼裂变小。体温40℃，食欲下降，精神萎靡。该患者最有可能的诊断为
A. 右上颌骨骨髓炎
B. 右上颌窦化脓性炎症
C. 右侧眶下间隙感染
D. 右上颌窦肿瘤继发感染
E. 右鼻侧皮肤感染

正确答案：C。右侧眶下间隙感染

解析：本题考查眶下间隙感染。眶下间隙感染（C对）常波及内眦、眼睑、颧部皮肤。肿胀区皮肤发红，眼睑水肿、睑裂变窄、鼻唇沟消失。脓肿形成后，眶下区可触及波动感。上颌骨骨髓炎（A错）主要为新生儿颌骨骨髓炎，多为血源性感染，面部、眶下及内眦皮肤红肿，迅速向眼睑扩散，出现眼睑肿胀，甚至完全闭合，结膜外翻或眼球外突，提示眶周蜂窝织炎。上颌窦化脓性感染（B错）时，患侧上后牙出现类似牙髓炎的疼痛症状，疼痛可放散至头面部，急性时为持续性胀痛，伴有头痛、鼻塞、脓涕等上呼吸道感染症状，体位突然改变时牙痛加重，上颌窦前壁有压痛。上颌窦肿瘤继发感染（D错）、右鼻侧皮肤感染（E错）一般无牙痛史，即使炎症累及牙齿，但未查及牙体组织疾患。